患者，男，43岁，有季节性过敏性结膜炎，该患者适宜选用药物是
A. 左氧氟沙星滴眼液
B. 毛果芸香碱滴眼液
C. 玻璃酸钠滴眼液
D. 色甘酸钠滴眼液
E. 阿昔洛韦滴眼液

正确答案：D。色甘酸钠滴眼液

解析：本题考查色甘酸钠滴眼液。醋酸可的松、醋酸氢化可的松或色甘酸钠滴眼液（D对）和眼膏用于过敏性结膜炎。左氧氟沙星滴眼液（A错）可用于治疗由细菌所致的结膜炎。毛果芸香碱滴眼液（B错）可用于治疗青光眼。使用人工泪液（玻璃酸钠滴眼液（C错）、羟甲基纤维素钠滴眼液、聚乙醇滴眼液等）可改善眼部干燥症状。阿昔洛韦滴眼液（E错）用于单纯疱疹性角膜炎。